女，2岁。自幼牛乳喂养，未按要求添加辅食，有时腹泻，逐渐消瘦。体检：身高80cm，体重7000g，皮下脂肪减少，腹壁皮下脂肪厚度＜0.4cm，皮肤干燥苍白，肌张力明显减低，肌肉松弛，脉搏缓慢，心音较低钝。假设此患儿清晨突然面色苍白，神志不清，体温不升，呼吸暂停。首先应考虑最可能的原因是
A. 急性心力衰竭
B. 低钾血症引起的呼吸肌麻痹
C. 重度脱水伴休克
D. 低钙血症引起的喉痉挛
E. 自发性低血糖

正确答案：E。自发性低血糖

解析：正常2岁儿童体重=年龄×2+8=2×2+8=12kg，而该患儿体重只有体重7000g，呈体重下降，并且有皮下脂肪减少、肌张力明显减低的表现，应诊断为营养不良。当患儿出现清晨突然面色苍白神志不清体温不升呼吸暂停时，应考虑为自发性低血糖（E对）。急性心力衰竭有发绀、呼吸困难等临床表现，与该患儿表现不符（A错）。低钾血症属于电解质失衡的范畴并不会出现生长发育异常的表现（B错）。该患儿只是有时腹泻不是频繁腹泻，不会发生重度脱水伴休克（C错）。低钙血症引起的喉痉挛是维生素D缺乏性手足搐搦症的并发症，营养不良不会发生此并发症（D错）。